不属于心衰治疗药物的是
A. 沙库巴曲缬沙坦
B. 地高辛
C. 托拉塞米
D. 比索洛尔
E. 阿司匹林

正确答案：E。阿司匹林

解析：本题考查抗心力衰竭药。阿司匹林（E错，为本题正确答案）不是抗心力衰竭药。抗心力衰竭药目前主要有9类：1.利尿剂（C对）；2.血管紧张素转化酶抑制剂（ACEI）；3.血管紧张素Ⅱ受体阻断剂（ARB）；4.β受体阻断剂（D对）；5.醛固酮受体阻断剂；6.血管紧张素受体脑啡肽酶抑制剂（ARNI），代表药物为沙库巴曲缬沙坦（A对）；7.钠-葡萄糖协同转运蛋白（SGLT2）抑制剂；8.伊伐布雷定；9.地高辛（B对）。